痫证风痰闭阻证主方
A. 涤痰汤
B. 定痫丸
C. 导痰汤
D. 镇肝熄风汤
E. 风引汤

正确答案：B。定痫丸

解析：定痫丸豁痰开窍，熄风定惊，适用于痰浊素盛，肝风内动，蒙蔽清窍之痫病（B对）。